婴幼儿的呼吸次数
A. 随年龄增加而增快
B. 随年龄增加而减慢
C. 年龄增加变化不大
D. 与性别显著相关
E. 与血压同步变化

正确答案：B。随年龄增加而减慢

解析：婴幼儿的呼吸次数随年龄增加而逐渐减慢，到7-14岁后基本处于成年人水平（B对）。（AC错）。呼吸次数的变化与性别差异无直接相关性（D错）。小儿年龄愈小，血压愈低，与呼吸负相关，不是同步（E错）。